氟康唑质量标准中，氟检查采用的方法是
A. 非水溶液滴定法
B. 旋光度测定法
C. 气相色谱法
D. 氧瓶燃烧-比色法
E. 红外分光光度法

正确答案：D。氧瓶燃烧-比色法

解析：本题考查有机氟化物的检查方法。有机氟化物经氧瓶燃烧法破坏，被碱性溶液吸收成为无机氟化物，与茜素氟蓝、硝酸亚铈在pH4.3溶液中形成蓝紫色络合物（D对）。